“壮水之主，以制阳光”的治法属于
A. 阳病治阴
B. 阴病治阳
C. 阳中求阴
D. 阴中求阳
E. 热者寒之

正确答案：A。阳病治阴

解析：“壮水”即滋阴,“以制阳光”即制约阳气的相对偏亢,故“壮水之主,以制阳光”,是指对于阴虚不足以制阳而导致阳气相对偏亢的虚热证时,当治宜滋阴(治病求本)以抑阳,此即“阳病治阴”(A对)。“阴病治阳”是指对“阳虚则寒”所出现的虚寒证，治宜扶阳以抑阴，即王冰所谓“益火之源，以消阴翳”（B错）。“阳中求阴”是指治疗阴虚证时，在滋阴剂中适当佐以补阳药（C错）。“阴中求阳”是指治疗阳虚证时，在助阳剂中适当佐以补阴药（D错）。对“阴胜则寒”所致的实寒证，宜用温热药物以消解其偏盛之阴寒，此即“寒者热之”之法（E错）。